口腔颌面部感染中最容易发生全身性并发症的是
A. 淋巴结炎
B. 面部疖痈
C. 颌骨骨髓炎
D. 智齿冠周炎
E. 颌面部间隙感染

正确答案：B。面部疖痈

解析：本题考查面部疖痈的并发症。口腔颌面部感染中最容易发生全身性并发症的是面部疖痈（B对）。单一毛囊及其附件的急性化脓性炎症称为疖，病变局限于皮肤浅层组织；相邻毛囊及其附件同时发生的急性化脓性炎症称为痈，可造成大范围的炎性浸润和组织坏死。口腔颌面部感染中面部疖痈最易发生全身并发症，其主要病原菌为金黄色葡萄球菌。面颈部淋巴结炎主要表现为下颌下、颏下及颈深上群淋巴结炎，有时也可见到面部、耳前、耳下淋巴结炎（A错）。